男性，45岁。诉左下颌后牙出现不适6个月求治。口腔检查：左下56残冠，叩诊（±），松动（-），已做过牙髓治疗，牙龈稍红，无法再修复，拟拔除。口内其他牙未见明显异常。X线片示：左下6远中根尖有阴影，距离下颌神经管较近。左下56拔除不需麻醉的神经是
A. 下牙槽神经
B. 舌神经
C. 咬肌神经
D. 颊神经
E. 以上神经均需麻醉

正确答案：C。咬肌神经

解析：本题考查左下56拔除需要麻醉的神经。咬肌神经支配咬肌的运动，若麻醉咬肌神经则可导致咬肌暂时失去收缩与舒张功能，并处于停滞状态，可出现牙关紧闭，不利于拔牙，所以拔牙时不能麻醉咬肌神经（C错，为本题的正确答案）。下牙槽神经（A对）支配双侧下颌1～8及其牙周膜、牙槽骨感觉；舌神经（B对）支配双侧下颌1～8的舌侧牙龈感觉；颊神经（D对）支配双侧下颌5～8颊侧牙龈、颊部皮肤和黏膜的感觉，所以拔除左下56时，应该麻醉下牙槽神经、舌神经、颊神经。